某男，28岁。于烈日下工作后，出现高热，汗多，头痛面红，烦躁，小便赤；舌红少津，脉洪大。辨证为阳暑，治以白虎汤（石膏、知母、甘草、粳米）。执业药师应具有临床思维，能根据临床诊断及方药组成分析处方的合理性。此方体现的治法是
A. 清营凉血
B. 清脏腑热
C. 清气分热
D. 清热解毒
E. 气血两清

正确答案：C。清气分热

解析：本题考查的是中药处方用药适宜性。某男，28岁。于烈日下工作后，出现高热，汗多，头痛面红，烦躁，小便赤；舌红少津，脉洪大。辨证为阳暑，治以白虎汤（石膏、知母、甘草、粳米）。执业药师应具有临床思维，能根据临床诊断及方药组成分析处方的合理性。此方体现的治法是清气分热（C对）。中药处方根据辨证诊断合理选择方药：中医临床辨证治疗讲究理法方药，治法是指导遣方组药的原则，方剂是体现和完成治法的重要手段。方从法出，法随证立。常见治法及其代表方剂，如麻黄汤属汗法、逍遥散属和法、大承气汤属下法、保和丸属消法、瓜蒂散属吐法、白虎汤属清法、理中丸属温法、四君子汤属补法等。病、证不同则方不同。常见病证及其代表方剂，如小柴胡汤和解少阳用于少阳证，四逆散和逍遥散用于调和肝脾，半夏泻心汤调和寒热用于寒热错杂之痞证，白虎汤清气分热用于阳明气分热盛证，清营汤清营凉血（A错）用于热入营血证，黄连解毒汤和普济消毒饮清热解毒（D错）分别用于三焦火毒证和大头瘟，导赤散清心利水养阴用于心经火热证和心火下移小肠证，龙胆泻肝汤清肝胆实火和肝胆湿热用于肝胆实火上炎证和肝胆湿热下注证等。同类中药因病证不同而选择不同。如同样是补气药，四君子汤因证的轻重不同可分别选用党参、人参或太子参作为君药；同样是表证，表实证可用麻黄做君药，表虚证可选用桂枝为君药；同样是头痛，太阳头痛用羌活，阳明头痛用白芷、厥阴头痛用藁本或吴茱萸、鼻渊头痛用辛夷或细辛等。